应慎用糖皮质激素的病症有
A. 急性心力衰竭
B. 糖尿病
C. 眼单纯性疱疹
D. 骨关节炎
E. 骨质疏松

正确答案：A、B、C、E。急性心力衰竭；糖尿病；眼单纯性疱疹；骨质疏松

解析：本题考查糖皮质激素的慎用症。库欣综合征、动脉粥样硬化、肠道疾病或慢性营养不良的患者及近期手术后的患者慎用。急性心力衰竭（A对）、糖尿病（B对）、有精神病倾向、青光眼、高脂蛋白血症型、高血压、重症肌无力、严重骨质疏松（E对）、消化性溃疡、妊娠及哺乳期妇女应慎用。糖皮质激素还可诱发病毒感染，而眼单纯性疱疹（C对）属于病毒感染，故患者应该慎用。